女孩，4岁，发热、头痛3天，呕吐2次呈喷射状。入院当天晚上开始频繁抽搐，呈全身性。3~4分钟停止。抽搐后昏睡.体温39℃，面色灰白.血白细胞22×10⁹/L，中性粒细胞88%。该患儿疾病的病变部位主要见于
A. 硬脑膜
B. 软脑膜
C. 软脑膜及蛛网膜
D. 大脑皮质
E. 脑室膜

正确答案：C。软脑膜及蛛网膜

解析：学龄前儿童，发热、头痛3天，呕吐2次呈喷射状，入院当天晚上开始频繁抽搐，呈全身性，3～4分钟停止，抽搐后昏睡，体温39℃（正常值为正常值为36℃～37℃，发热，高热），面色灰白，血白细胞22×10⁹/L（正常值为4～10×10⁹/L，白细胞升高），中性粒细胞88%（正常值为50%～70%，中性粒细胞增高），该患儿拟诊断为化脓性脑膜炎，该患儿疾病的病变部位主要见于软脑膜及蛛网膜（C对），表现为广泛性血管充血、大量中性粒细胞浸润和纤维蛋白渗出，伴有弥漫性血管源性和细胞毒性脑水肿。